男性，25岁。腹部被倒墙压伤，中腹部剧痛伴呕吐3小时。血压120/86mmHg，体温38℃；腹胀、肌紧张、压痛、反跳痛阳性，肠鸣音消失。最可能的诊断是
A. 腹壁挫伤
B. 腹膜后血肿
C. 肝破裂Ⅰ°
D. 小肠破裂
E. 右肾挫伤

正确答案：D。小肠破裂

解析：青年男性患者，腹部外伤后出现中腹部疼痛伴呕吐，血压120/86mmHg（正常范围为90～139/60～89mmHg，提示患者失血量不大），腹部压痛、反跳痛阳性，腹肌紧张，肠鸣音消失（腹膜刺激征明显，提示为空腔脏器损伤），结合患者病史和体查，最可能的诊断是小肠破裂（D对）。腹壁挫伤（A错）多表现为腹壁局部疼痛、肿胀、出血；肾挫伤（P523）（E错）主要表现为血尿、腰痛等症状，两者均不会出现腹膜刺激症状。腹膜后血肿（B错）、肝破裂（P323）（C错）主要表现为血压下降、脉率加快等内出血症状，腹膜刺激征常较脾破裂更为明显。